患者眩晕，精神萎靡，健忘多梦，腰膝痠软，四肢不温，形寒怯冷，舌质淡，脉沉细无力。治疗应首选
A. 左归丸
B. 右归丸
C. 大定风珠
D. 大补元煎
E. 附子理中丸

正确答案：B。右归丸

解析：本病例以眩晕为主诉，故诊断为眩晕；精髓不足，不能上充于脑，故眩晕，精神萎靡；肾虚则心肾不交，故健忘多梦；腰为肾之府，肾虚则腰膝酸软；偏于阳虚则生外寒，故四肢不温，形寒怯冷，舌质淡，脉沉细无力，故诊断为肾精不足证，偏于肾阳虚，治以温补肾阳，填精益髓，代表方为右归丸（B对）。左归丸，其功用为滋阴补肾，填精益髓，可用于肾精不足证，偏于肾阴虚者(A错)。大定风珠，其功用为滋阴熄风，适应于阴虚风动证（C错）。大补元煎，其功用为救本培元，大补气血，适用于气血大亏，精神失守之危重症（D错）。附子理中丸，其功用为温阳祛寒，补气健脾，可用于治疗胃痛之脾胃虚寒兼有形寒肢冷、腰膝酸软者（E错）。